乳牙修复治疗下列哪一项描述是错误的
A. 广泛龋也可以树脂修复
B. 近髓处可用氢氧化钙护髓
C. 必须采用双层垫底
D. 玻璃离子是较为理想的充填材料
E. 前牙后牙均可以采用复合树脂充填

正确答案：C。必须采用双层垫底

解析：本题考查乳牙修复治疗。乳牙修复治疗下列描述错误的是必须采用双层垫底（C错，为本题的正确答案）。是否双层垫底需要看具体情况，龋坏的程度。而不是说必须要双层垫底。广泛龋也可以树脂修复（A对）；近髓处可用氢氧化钙护髓（B对）；玻璃离子是较为理想的充填材料（D对）；前牙后牙均可以采用复合树脂充填（E对）对乳牙修复治疗的描述均是正确的。